Sheehan综合征的体征是
A. 苦笑面容
B. 满月脸
C. 面色苍白
D. 毛发旺盛
E. 色素沉着

正确答案：C。面色苍白

解析：Sheehan综合征属于腺垂体功能减退，垂体ACTH、黑素细胞刺激素分泌减少致面色苍白（C对）。Sheehan患者毛发减少（D错）。苦笑面容（A错）见于破伤风。满月脸（B错）见于库欣综合征及长期应用糖皮质激素者。色素沉着（E错）是Addison病最具特征性表现，是原发性肾上腺皮质功能减退负反馈致垂体ACTH、黑素细胞雌激素分泌增多所致。